苯丙酮尿症血液中增高的是
A. 酪氨酸
B. 苯丙酮酸
C. 多巴胺
D. 5-羟色胺
E. 丙氨酸

正确答案：B。苯丙酮酸

解析：苯丙酮酸尿症是由于缺乏苯丙氨酸羟化酶引起的。缺乏苯丙氨酸羟化酶时，苯丙氨酸无法转化为酪氨酸，血液中增高的苯丙氨酸（B对）经转氨基作用大量生成苯丙酮酸，大量苯丙酮酸及其大部分代谢产物由尿排出，成为苯丙酮酸尿症。